按Black窝洞分类法第Ⅲ类洞为
A. 开始于窝沟的洞
B. 后牙邻面洞
C. 前牙邻面洞不包括切角
D. 前牙邻面洞包括切角
E. 牙齿唇、颊或舌面颈三分之一的洞

正确答案：C。前牙邻面洞不包括切角

解析：本题考查Black分类法。按Black窝洞分类法第Ⅲ类洞为前牙邻面洞不包括切角（C对）。Ⅰ类洞：所有牙面发育点隙裂沟的龋损所备成的窝洞（A错）。Ⅱ类洞：后牙邻面的龋损所备成的窝洞（B错）。Ⅲ类洞：前牙邻面未累及切角的龋损所备成的窝洞。Ⅳ类洞：前牙邻面累及切角的龋损所备成的窝洞（D错）。Ⅴ类洞：所有牙齿颊（唇）舌面颈1/3处的龋损所备成的窝洞（E错）。Ⅵ类洞：前牙切嵴或后牙牙尖发生的龋损所备成的窝洞。